聚丙烯酰胺作为常用的混凝剂，其特点为
A. 对水质无不良影响，效果一般
B. 对水质无不良影响，效果一般对低浊和高浊水效果均好，价格昂贵，其毒性较高
C. 腐蚀性小，对水质有些影响，水温低时絮凝体形成较紧密
D. 腐蚀性小，对水质无不良影响，但使用不方便
E. 腐蚀性大，易潮湿，适应pH范围较广，絮凝体大而紧密

正确答案：B。对水质无不良影响，效果一般对低浊和高浊水效果均好，价格昂贵，其毒性较高

解析：本题考查聚丙烯酰胺的特点。聚丙烯酰胺是一种非离子型线型高分子聚合物，具有吸附架桥作用。其优点是对低浊和高浊水效果均好；缺点是价格昂贵，产品中常含有微量未聚合的单体，其毒性甚高（B对ACDE错），应予重视。